下列化合物哪一个不是胆色素
A. 血红素
B. 胆绿素
C. 胆红素
D. 胆素原族
E. 胆素族

正确答案：A。血红素